下列哪项不属于安宫牛黄丸的辨证要点
A. 舌红或绛
B. 脉数
C. 高热烦躁
D. 神昏谵语
E. 斑疹吐衄

正确答案：E。斑疹吐衄

解析：安宫牛黄丸为治疗热陷心包证之常用方，凉开法之代表方。方中牛黄味苦性凉，善清心解毒，豁痰开窍；麝香通行十二经，善于开窍通关，为开窍醒神回苏的要药，共为君药。水牛角清心凉血解毒而定惊；黄连、黄芩、栀子助牛黄清热泻火解毒；冰片、郁金芳香辟秽，通窍开闭，助麝香以开窍，同为臣药。朱砂镇心安神；珍珠清心安神，以除烦躁不安；雄黄豁痰解毒，共为佐药。蜂蜜和胃调中，为使药。金箔为衣，取其重镇安神之效，故以高热烦躁，神昏谵语，舌红或绛，脉数为辨证要点（E错，为本题正确答案）。